诊断肝细胞癌最特异的实验室指标是
A. GCT-Ⅱ
B. AFP
C. ALT
D. γ球蛋白
E. AFU

正确答案：B。AFP

解析：诊断肝细胞癌最特异的实验室指标为AFP（甲胎蛋白）（B对），现已广泛用于肝癌的普查、诊断、判断治疗效果及预测复发，在排除妊娠和生殖腺胚胎瘤的基础上，AFP＞400ng/ml为诊断肝癌的条件之一。ALT（谷丙转氨酶）（C错）为肝功能异常的实验室指标，增高见于肝炎、肝硬化活动期等。AFU（α-L-岩藻糖苷酶）（E错）在原发性肝癌患者血清中增高，是原发性肝癌的标志物之一，但不是最特异的标志物。GCT-Ⅱ（A错）为Ⅱ级骨巨细胞瘤，基质细胞多而密集，核分裂较多，多核巨细胞数目减少。γ球蛋白（D错）增高几乎在所有肝胆疾病中均出现。